患者咳嗽咽痒，微有恶寒发热，舌苔薄白，脉浮。治疗应选用
A. 小青龙汤
B. 清气化痰丸
C. 温胆汤
D. 半夏白术天麻汤
E. 止嗽散

正确答案：E。止嗽散

解析：患者咳嗽咽痒，微有恶寒发热，舌苔薄白，脉浮。为外感咳嗽，经服解表宣肺药后而咳仍不止者。方用止嗽散。紫菀、百部止咳化痰；荆芥疏风解表，以驱在表之余邪，陈皮理气化痰；甘草调和诸药，桔梗利咽止咳（E对）。小青龙汤主治外感风寒，寒饮内停之证（A错）。清气化痰汤证因痰郁气滞，气郁化火，痰热互结所致。为治疗热谈咳嗽的常用方（B错）。温胆汤方证多因素体胆气不足，复由情志不遂，胆失疏泄，气郁生痰，痰浊内扰，胆胃不和所致。为治疗胆郁痰扰所致不眠、惊悸、呕吐及眩晕、癫痫的常用方（C错）。半夏白术天麻汤证缘于脾湿生痰，湿痰壅遏，引动肝风，风痰上扰清空所致。为治风痰眩晕、头痛的常用方（D错）。记忆：止嗽散中有荆桔，百部紫菀草陈前。